从锥体与橄榄之间的沟出脑的神经是
A. 舌咽神经
B. 迷走神经
C. 副神经
D. 舌下神经
E. 展神经

正确答案：D。舌下神经

解析：舌下神经（D对）从锥体与橄榄之间的沟出脑；舌咽神经（A错）连千延髓橄榄后沟上部，与迷走神经、副神经同穿颈静脉孔前部出入颅腔；迷走神经（B错）连于橄榄后沟，舌咽神经下方，与舌咽神经和副神经一起穿颈静脉孔出颅；副神经（C错）与延髓根合成副神经一起经颈静脉孔出颅；展神经（E错）起于脑桥的展神经核，自脑桥延髓沟中线两侧出脑。